治痰涎壅塞、宿食停滞可用
A. 化痰法
B. 通下法
C. 消导法
D. 涌吐法
E. 健脾法

正确答案：D。涌吐法